患者，男，56岁。有高血压病史4年。体检：血压156/96mmHg，无主动脉狭窄。医师处方依那普利片控制血压。该患者用药过程中可能发生的典型不良反应是
A. 低血糖
B. 光过敏
C. 干咳
D. 水肿
E. 口干

正确答案：C。干咳

解析：本题考查依那普利的不良反应。服用依那普利过程中易出现干咳（C对）。 低血糖（A错）是口服降糖药时会出现的典型不良反应。光过敏（B错）现象是使用胺碘酮会产生的不良反应。使用血管紧张素Ⅱ受体阻断剂及肾素抑制剂治疗高血压时会发生水肿（D错）。甲基多巴在治疗高血压时会出现口干（E错）、便秘等现象。